中药番红花的正名是
A. 红花
B. 藏红花
C. 西红花
D. 草红花
E. 红蓝花

正确答案：C。西红花

解析：本题考查的是常见的中药正名与相关别名。中药番红花的正名是西红花（C对）。中药西红花的别名有藏红花（B错）与番红花。中药红花（A错）的别名有草红花（D错）与红蓝花（E错）。